熊胆除清热解毒外，又能
A. 疏风平肝
B. 通利关节
C. 燥湿止带
D. 解暑，截疟
E. 明目，止痉

正确答案：E。明目，止痉

解析：本题考查的是熊胆的功效。熊胆除清热解毒外，又能明目，止痉（E对）。熊胆【功效】清热解毒，明目，止痉。野菊花【功效】清热解毒，疏风平肝（A错）。土茯苓【功效】解毒，利湿，通利关节（B错）。秦皮【功效】清热解毒，燥湿止带（C错），清肝明目。青蒿【功效】退虚热，凉血，解暑，截疟（D错）。